容量瓶校正所需的仪器有
A. 分析天平
B. 称量瓶
C. 滴定管
D. 温度计
E. 比色管

正确答案：A、D。分析天平；温度计